不属于消化腺的是
A. 肝
B. 舌下腺
C. 胰
D. 甲状腺
E. 腮腺

正确答案：D。甲状腺

解析：肝(A对)、舌下腺(B对)、胰(C对)、腮腺(E对)均属于消化腺，而甲状腺(D错，为本题正确答案)分泌物质无消化功能，不属于消化腺。